在下列选项中，不属于医学伦理学的基本原则是
A. 不伤害原则
B. 人道原则
C. 有利原则
D. 尊重原则
E. 公正原则

正确答案：B。人道原则

解析：目前对我国影响较大的美国生命伦理基本原则有“二原则说”、“四原则说”、“五原则说”等。其中生命伦理四原则经修改后逐渐成为我国教科书中的主要内容，即医学伦理学原则，分别为“尊重原则（D对）、不伤害原则（A对）、有利原则（C对）、公正（E对）原则，不包括人道原则（B错，为本题正确答案）。